既能祛风湿，又能强腰膝的药物是
A. 威灵仙
B. 防己
C. 狗脊
D. 独活
E. 木瓜

正确答案：C。狗脊

解析：该题考查狗脊的功效。狗脊味苦、甘，性温，归肝、肾经，其功效为祛风湿，补肝肾，强腰膝（C对）。